不通向颅底外面
A. 卵圆孔
B. 棘孔
C. 颈静脉孔
D. 枕骨大孔
E. 内耳门

正确答案：E。内耳门

解析：内耳门不通颅底外面（E错，为本题正确答案），卵圆孔（A对）、棘孔（B对）、颈静脉孔（C对）、枕骨大孔均是通向颅底外面（D对）。